以下有关窝洞结构的论述中，错误的是
A. 内壁与内壁相交处形成洞角
B. 洞壁分为侧壁和髓壁
C. 洞角分线角和点角
D. 与牙体长轴平行的髓壁又称龈壁
E. 髓壁是位于洞底覆盖牙髓的洞壁

正确答案：D。与牙体长轴平行的髓壁又称龈壁

解析：洞壁经过制备具特定形状的窝洞，由洞内壁所构成。洞壁分为侧壁和髓壁。侧壁以所在牙面命名，如位于颊面者称颊壁，靠近龈缘者称龈壁。位于洞底覆盖牙髓的洞壁称髓壁。与牙体长轴平行的髓壁又称轴壁。掌握“银汞充填窝洞的概念”知识点。